为减少共济失调，幻觉及“宿醉现象”，老年失眠患者宜选用
A. 苯巴比妥
B. 劳拉西泮
C. 佐匹克隆
D. 水合氯醛
E. 地西泮

正确答案：C。佐匹克隆

解析：本题考查抗失眠药。为减少患者共济失调、幻觉、提高睡眠质量且无宿醉反应和成瘾性，老年失眠患者推荐使用非苯二氮䓬类药物如佐匹克隆（C对）。苯巴比妥（A错）用于镇静、催眠、抗惊厥、抗癫痫等。劳拉西泮（B错）临床用于治疗焦虑症及由焦虑、紧张引起的失眠症。水合氯醛（D错）可以做催眠药和抗惊厥药，用于失眠烦躁不安及惊厥。地西泮（E错）为苯二氮䓬类抗焦虑药，具有抗焦虑、镇静、催眠、抗惊厥、抗癫痫及中枢性肌肉松弛作用。